心纤维骨骼的瓣纤维环不存在于下列哪种结构周围
A. 主动脉口
B. 肺动脉口
C. 冠状窦口
D. 左房室口
E. 右房室口

正确答案：C。冠状窦口

解析：主动脉口（A对）、肺动脉口（B对）、左房室口（D对）、右房室口（E对）周围均存在心纤维骨骼的瓣纤维环。冠状窦口（C错，为本题正确答案）周围不存在心纤维骨骼的瓣纤维环。